牙周脓肿的发病因素不包括
A. 牙周袋壁的化脓性炎症向深部发展，脓液不能排入袋内
B. 牙周袋迂迥曲折、涉及多个牙面，脓性渗出物不能顺利引流
C. 洁治，刮治动作粗暴，将牙石碎片推入牙周袋深部
D. 异物刺入牙间乳头，引起化脓性炎症
E. 根管治疗时髓室底或根管壁侧穿，引起化脓性炎症

正确答案：D。异物刺入牙间乳头，引起化脓性炎症

解析：本题考查牙周脓肿的发病因素。异物刺入牙间乳头，引起化脓性炎症（D错，为本题的正确答案）是牙龈脓肿的发病因素。牙周脓肿并非独自的疾病，而是牙周炎发展到晚期，出现深牙周袋后的一个较常见的伴发症状。牙周脓肿的发病因素包括：深牙周袋内壁的化脓性炎症向深部结缔组织扩散，而脓液不能排入袋内（A对）时，即形成袋壁软组织内的脓肿；迂回曲折的、涉及多个牙面的复杂型深牙周袋，脓性渗出物不能顺利引流（B对），特别是累及根分叉区时；洁治或刮治时，动作粗暴，将牙石碎片推入牙周袋深部组织（C对），或损伤牙龈组织；牙髓治疗时根管及髓室底侧穿、牙根纵裂等，有时也可引起化脓性炎症（E对）。